下列脑脊液检查结果，符合狂犬病的是
A. 压力明显升高
B. 蛋白明显增加
C. 细胞数多高于200×10⁶/L
D. 以淋巴细胞为主
E. 糖和氯化物降低

正确答案：D。以淋巴细胞为主

解析：狂犬病的脑脊液检查结果：压力正常或轻度升高（A错），细胞数低于200×10⁶/L（C错），以淋巴细胞为主（D对），蛋白轻度升高（B错），糖和氯化物正常（E错）。